以下关于指导-合作型的医患关系模式的描述中，正确的是
A. 完全按医生的要求去做，听从医生的支配
B. 患者能充分发挥自己的主观能动性
C. 患者在医师指导下自己治疗
D. 医生的作用占优势，同时有限度地调动病人的主动性
E. 患者与医师有同等权力和主动性

正确答案：D。医生的作用占优势，同时有限度地调动病人的主动性

解析：指导-合作型这是一种微弱单向、以生物心理社会医学模式为指导思想的医患关系，其特征是“医生教会病人做什么”。在这种医患关系中，医生的作用占优势，同时有限度地调动病人的主动性，也就是说，医生是主角，病人是配角。这种模式主要适用于急性病病人的治疗过程，因为此类病人神志清楚，但病情重、病程短，对疾病的治疗及预后了解少，自觉地把医生放在有相当权威的地位上，相信医生掌握了足够的知识和技能来帮助自己，所以愿意听从医生的意见，配合医生的安排。掌握“医患沟通的理论、技术与其应用以及医患关系模式”知识点。